最敏感的致死剂量指标是
A. 绝对致死剂量
B. 半数致死剂量
C. 最小致死剂量
D. 以上都是

正确答案：B。半数致死剂量

解析：本题考查最敏感的致死剂量指标。半数致死剂量（B对ACD错）指引起一组受试实验动物半数死亡的剂量或浓度，是最敏感的致死剂量指标。它常用以表示和比较急性毒性的大小，LD₅₀数值越小，表示外源化学物的毒性越强，反之LD₅₀数值越大，则毒性越低。